氯霉素在pH7以下生成氨基物和二氯乙酸的变化属于
A. 水解
B. 氧化
C. 异构化
D. 聚合
E. 脱羧

正确答案：A。水解

解析：本题考查药物的降解途径。水解（A对）是药物降解的主要途径。属于这类降解的药物主要有酯类、酰胺类等。（1）酯类药物的水解：含有酯键的药物在水溶液中或吸收水分后，易发生水解反应，在H⁺或OH⁻或广义酸碱的催化下，反应还可加速。（2）酰胺药物的水解：酰胺药物水解后生成酸与胺。属于这类的药物有青霉素类、头孢菌素类、氯霉素、巴比妥类等。氯霉素属于酰胺类药物，酰胺类药物分子中存在着不稳定的β-内酰胺环，易水解成酸与胺。氯霉素在pH7以下生成氨基物和二氯乙酸的变化就是酰胺类药物典型的β-内酰胺环水解反应。氧化（B错）是氧元素与其它物质元素发生的变化。异构化（C错）是改变化合物的结构而不改变其组成和分子量的过程。聚合（D错）是两个或多个分子结合在一起形成复杂分子的过程。脱羧（E错）是在特殊情况下，羧酸脱去羧基的反应。